患者查阅医疗记录和复印部分病历的权利属于
A. 知情同意权
B. 隐私保护权
C. 特殊干涉权
D. 平等就医权
E. 损害赔偿权

正确答案：A。知情同意权

解析：知情同意权包括知情权和同意权两个方面，知情权是指患者有权了解和认识自己所患疾病，包括检查、诊断、治疗、处理及预后等方面的情况，并有权要求医生做出通俗易懂的解释...有权查阅医疗记录，知悉病历中的信息，并有权复印病历等。同意权是指患者及其家属有权接受或拒绝某项治疗方案及措施，故患者查阅医疗记录和复印部分病历的权利属于知情同意权（A对）。